心肌细胞可分为快反应细胞和慢反应细胞，主要是根据动作电位的
A. 0期去极速度
B. 1期复极速度
C. 平台期复极速度
D. 3期复极速度
E. 4期自动去极速度

正确答案：A。0期去极速度